尖牙卡环小连接体与卡环臂相连是在
A. 颊面
B. 舌面
C. 腭面
D. 近中邻面
E. 远中邻面

正确答案：E。远中邻面

解析：尖牙卡环：用于尖牙，尤其是下颌尖牙。卡环由近中切支托顺舌面近中边缘嵴向下，经舌隆突、舌面远中边缘嵴向上至远中切角，向下向前进入唇面近中倒凹。小连接体在远中邻面与卡环臂相连。掌握“局部义齿固位体”知识点。